易发生神经和血管损伤的骨折
A. 骨盆骨折
B. 肱骨髁上骨折
C. 股骨颈骨折
D. 锁骨骨折
E. Colles骨折

正确答案：B。肱骨髁上骨折

解析：肱骨髁内、前方有肱动脉、正中神经经过，内侧有尺神经，外侧有桡神经，均可因肱骨髁上骨折使这些神经血管受到损伤（B对）。骨盆骨折（A错）可导致骨盆附近的众多动、静脉丛破裂，引起广泛出血，但神经损伤不常见。股骨颈骨折（P657）（C错）可造成旋股内侧动脉损伤，神经损伤不常见。锁骨骨折（D错）只有当骨折移位明显时才有可能出现臂丛神经和锁骨下血管损伤。Colles骨折（P641）（E错）即桡骨远端伸直型骨折，伤后局部疼痛、肿胀、可出现典型畸形姿势，即“银叉”畸形或“枪刺”畸形，神经血管损伤不常见。